鼓岬后下方有
A. 鼓室盖壁
B. 面神经凸
C. 蜗窗
D. 锥隆起
E. 乳突窦

正确答案：C。蜗窗

解析：鼓室盖壁为鼓室的上壁（A错）。面神经凸（B错）位于前庭窗的后上方。蜗窗（C对）位于岬的后下方。后壁为乳突壁，上部有乳突窦的入口（E错）。锥隆起（D错）位于乳突窦入口的下方。